正常的白蛋白与球蛋白的比例（A/G）为
A. 0.5～1.0
B. 1.0～1.5
C. 1.0～2.0
D. 1.5～2.5
E. 2.5～3.5

正确答案：D。1.5～2.5

解析：正常的白蛋白与球蛋白的比例（A/G）为1.5～2.5。掌握“血液成分及血浆蛋白”知识点。